患儿，10岁。经常挤眉眨眼，耸肩摇头，口出秽语，肢体震颤，大便干结，五心烦热，两颧潮红，形体消瘦，舌质红绛，舌苔光剥，脉细数无力。治疗应首选
A. 大定风珠
B. 醒脾散
C. 千金龙胆汤
D. 礞石滚痰丸
E. 川芎茶调散

正确答案：A。大定风珠

解析：患儿以“经常挤眉眨眼，耸肩摇头，口出秽语，肢体震颤”为主症，首先考虑为多发性抽动症。多发性抽动症又称抽动-秽语综合征临床以慢性、波动性、多发性运动肌快速抽搐，伴有不自主发声和语言障碍为特征，常表现为一组肌群抽动，如频繁眨眼、甩头、耸肩等运动性抽动及发声性抽动。根据“大便干结，五心烦热，两颧潮红，形体消瘦，舌质红绛，舌苔光剥，脉细数无力”，可辨证为阴虚证，故此为阴虚风动证，当治以滋阴潜阳，柔肝熄风，首选大定风珠（A对）。醒脾散（B错）其功用为益气健脾，平肝息风，适用于多发性抽动症之脾虚肝旺证。千金龙胆汤（C错）其功用为清肝泻火，息风镇惊，可用于多发性抽动症之肝亢风动证。礞石滚痰丸（D错）其功用为泻火涤痰，清心安神，适用于多发性抽动症之痰火扰心证。川芎茶调散（E错）其功用为疏风止痛，适用于外感风邪头痛。